唾液腺中最大的腺体是
A. 腮腺
B. 下颌下腺
C. 舌腺
D. 腭腺
E. 唇腺

正确答案：A。腮腺

解析：腮腺是唾液腺中最大者。掌握“唾液腺组织学特点”知识点。